上唇外面与颊部交界处有
A. 口角
B. 口腔前庭
C. 鼻唇沟
D. 腮腺管乳头
E. 人中

正确答案：C。鼻唇沟

解析：鼻唇沟(C对)为上唇外面的两侧与颊部交界处的斜行浅沟，口角(A错)为由口裂两侧上、下唇结合处形成，口腔前庭(B错)为唇、颊、牙弓与牙龈之间的狭窄间隙，腮腺管乳头(D错)位于上颌第2磨牙牙冠相对的颊黏膜上，人中(E错)为上唇外面中线处的纵行浅沟。